男，56岁。尿中泡沫增多2年，间断双下肢水肿，晨轻暮重半年。既往患2型糖尿病15年，目前使用二甲双胍(1.5g/日）联合预混胰岛素30R(早、晚餐前皮下注射）治疗。冠心病病史10年，2年前行PTCA治疗。查体：BP155/85mmHg，腹型肥胖，心肺无显著异常，双下肢轻度凹陷性水肿。尿蛋白(++）。入院后监测血压波动于140～150/75～85mmHg，首选的降压药物是
A. α受体拮抗剂
B. ACEI或ARB类
C. β受体拮抗剂
D. 利尿剂
E. 钙通道阻滞剂

正确答案：B。ACEI或ARB类

解析：患者中年男性，尿中泡沫增多2年（蛋白尿），间断双肢水肿，间断双下肢水肿半年（考虑体循环淤血）。既往患2型糖尿病15年，目前使用二甲双胍（1.5g/日）联合预混胰岛素30R（早、晚餐前皮下注射）治疗。冠心病病史10年，2年前行PTCA治疗。查体：BP155/85mmHg（正常值90～120/60～90mmHg），腹型肥胖，心肺无显著异常，双下肢轻度凹陷性水肿。尿蛋白（++）。入院后监测血压波动于140～150/75～85mmHg。结合患者病史、体征及实验室检查考虑诊断为高血压合并肾功能不全、2型糖尿病、心衰、PTCA术后。首选的降压药为ACEI或ARB类（B对）。α受体拮抗剂（A错）是指可以选择性的与α肾上腺受体结合，并不激动或减弱激动肾上腺素受体，却能阻滞相应的神经递质及药物与α受体结合，从而产生抗肾上腺素作用。主要可用于肾上腺嗜铬细胞瘤引起的高血压危象。β受体拮抗剂（C错）可通过抑制中枢和周围RAAS，抑制心肌收缩力和减慢心率而发挥降压作用，但对心肌收缩力、窦房结及房室结功能都有抑制作用。利尿剂（D错）通过排钠，减少细胞外容量，降低外周血管阻力降低血压。钙通道阻滞剂（E错）通过减弱兴奋-收缩偶联，降低阻力血管的收缩以降低血压。